延胡索主含
A. 香豆素类成分
B. 环烯醚萜苷类成分
C. 蒽醌类成分
D. 生物碱类成分
E. 黄酮类成分

正确答案：D。生物碱类成分

解析：本题考查的是延胡索的成分。延胡索主含生物碱类成分（D对）。延胡索【成分】含多种生物碱，其中有：延胡索甲素、延胡索乙素、原鸦片碱、延胡索庚素、癸素、壬素等。延胡索乙素为主要镇痛、镇静成分。白芷【成分】杭白芷含多种香豆精衍生物（A错）：主要有欧前胡素、异欧前胡素、别欧前胡素、珊瑚菜素、花椒毒素、异氧化前胡素等。胡黄连【成分】含有环烯醚萜糖苷（B错）：胡黄连苷Ⅰ、胡黄连苷Ⅱ、胡黄连苷Ⅲ、桃叶珊瑚苷，梓醇，还含香草酸，肉桂酸，阿魏酸等。大黄【成分】游离蒽醌衍生物（C错）有大黄酸、大黄素、大黄酚、芦荟大黄素、太黄素甲醚等，为大黄的抗菌成分。葛根【成分】含黄酮类（E错）物质，总量可达12%。其中主要为：黄豆苷、黄豆苷元及葛根素等。